龟甲、鳖甲的功效相同点是
A. 养阴清肺
B. 滋阴潜阳
C. 燥湿健脾
D. 补气生津
E. 补肾助阳

正确答案：B。滋阴潜阳

解析：本题考查的是龟甲与鳖甲的功效。龟甲、鳖甲的功效相同点是滋阴潜阳（B对）。龟甲：【功效】滋阴潜阳，益肾健骨，养血补心，凉血止血。鳖甲：【功效】滋阴潜阳，退热除蒸，软坚散结。北沙参：【功效】养阴清肺（A错），益胃生津。白术：【功效】补气健脾，燥湿（C错）利水，止汗，安胎。太子参：【功效】补气生津（D错）。海马：【功效】补肾助阳（E错），活血散结，消肿止痛。